女性发生系统性红斑狼疮（SLE）的可能性比男性大10～20倍的原因是
A. 性激素的作用
B. 补体成分含量增加
C. 胰岛素异常
D. 表位扩展
E. B淋巴细胞的多克隆激活

正确答案：A。性激素的作用

解析：性激素也会影响自身免疫性疾病的发生。女性发生多发性硬化和SLE的可能性比男性大10～20倍。掌握“常见口腔自身免疫性疾病及自身免疫性疾病的治疗”知识点。